扁平苔藓有
A. 鳞状化生
B. 角化珠
C. 胶样小体
D. 角质栓塞
E. 影细胞

正确答案：C。胶样小体

解析：本题考查扁平苔藓的病理变化。扁平苔藓上皮的棘层、基底层或黏膜固有层可见胶样小体（C对）。鳞状化生（A错）和角化珠（B错）可见于过度角化，扁平苔鲜的黏膜白色条纹处上皮为不全角化，黏膜发红处上皮无角化。角质栓塞可见于慢性盘状红斑狼疮（D错）。影细胞可见于牙源性钙化囊性瘤、牙本质生成性影细胞瘤（E错）。